主动脉瓣关闭不全，多表现为
A. 脉搏短绌
B. 水冲脉
C. 奇脉
D. 颈静脉搏动
E. 交替脉

正确答案：B。水冲脉

解析：主动脉瓣关闭不全，多表现为水冲脉（B对）。脉搏短绌见于房颤（A错）。奇脉见于心脏压塞或缩窄性心包炎（C错）。颈静脉搏动见于右心衰竭等（D错）。交替脉见于高血压心脏病、急性心肌梗死等（E错）。